妊娠期营养不良，母体常常发生的营养缺乏病是
A. 营养不良性水肿
B. 骨质软化症
C. 营养性贫血
D. 妊娠并发症
E. 以上皆是

正确答案：E。以上皆是